在系统性疾病中，唇腭裂可以导致
A. 颌骨中央型骨髓炎
B. 颌骨肿瘤
C. 表皮样囊肿
D. 多生牙
E. 牙瘤

正确答案：D。多生牙

解析：能够发生多生牙的最常见的系统性疾病就是唇腭裂和颅骨发育不全综合征。掌握“迟萌、多生牙和融合牙”知识点。